下列药物质量控制项目中，应采用电泳法的有
A. 葡萄糖的鉴别
B. 冻干人血白蛋白的纯度检查
C. 硝苯地平的有关物质检查
D. 注射用重组人促红素的分子量测定
E. 阿奇霉素的含量测定

正确答案：B、D。冻干人血白蛋白的纯度检查；注射用重组人促红素的分子量测定

解析：本题考查毛细血管电泳法的应用。毛细血管电泳法的应用：1.鉴别供试品主成分迁移率应与对照品迁移率一致。如《中国药典》采用琼脂糖凝胶电泳法对肝素钠乳膏进行鉴别，其供试品溶液与对照品溶液所显斑点的迁移距离的比值应为0.9～1.1。2.分子量测定以相对迁移率与标准蛋白质的分子量对数，用标准曲线法计算供试品的分子量。如《中国药典》采用SDS-聚丙烯酰胺凝胶电泳法对注射用重组人促红素（CHO细胞）的分子量进行测定（D对），其分子量应为36～45kD。3.纯度检查采用峰面积按归一化法或内标法计算供试品纯度。如《中国药典》采用醋酸纤维素薄膜电泳法对冻干人血白蛋白进行纯度检查（B对），应不低于蛋白质总量的96.0%；采用琼脂糖凝胶电泳法对破伤风抗毒素进行纯度检查，对供试品溶液中自蛋白的检查，应不含或仅含痕量白蛋白迁移率的蛋白质组分；采用SDS-聚丙烯酰胺凝胶电泳法对肉毒抗毒素进行纯度检查，供试品中F（ab’），含量应不低于60%，IgG含量应不高于20%；采用毛细管电泳法对盐酸头孢吡肟中的N-甲基吡咯烷进行检查，以盐酸乙胺为内标，按内标法以峰面积计算，N-甲基吡咯烷不得过0.3%。4.等电点测定供试品的等电点图谱应与对照品一致。如《中国药典》采用等电聚焦电泳法对注射用重组人白介素-2进行等电点的测定，其主区带应为6.5～7.5，且供试品的等电点图谱应与对照品一致。5.分子组分比的测定以尿激酶中分子组分比的检查为例。葡萄糖的鉴别（A错）可用氧化反应、脱水反应。硝苯地平的有关物质检查（C错）和阿奇霉素的含量测定（E错）采用高效液相色谱法。